治疗失荣早期气郁痰结证，应首选
A. 和营散坚丸
B. 柴胡清肝汤
C. 桃红四物汤
D. 化痰开郁方
E. 二陈汤

正确答案：D。化痰开郁方

解析：失荣早期气郁痰结证的治法为理气解郁，化痰散结，为实证。和营散坚丸的功效为益气养荣，疏肝散结，适用于虚证（A错）。柴胡清肝汤的功效为养血清火，疏肝散结，用于血虚火动，肝气郁结（B错）。桃红四物汤功能活血化瘀，无理气解郁，化痰散结的功效（C错）。化痰开郁方功能理气解郁，化痰散结，为失荣气郁痰结证的首选方（D对）。二陈汤功能理气燥湿化痰，无散结的功效（E错）。